依据《野生药材资源保护管理条例》，国家对野生药材实行
A. 严格管理的原则
B. 保护和采猎相结合的原则
C. 严禁采猎的原则
D. 限量采猎的原则
E. 鼓励人工种养的原则

正确答案：B。保护和采猎相结合的原则

解析：本题考查野生药材资源保护。依据《野生药材资源保护管理条例》，国家对野生药材实行保护和采猎相结合的原则（B对）。国家重视中药材资源的保护、利用和可持续发展。为了保护和合理利用野生药材资源，适应人民医疗保健事业的需要，国务院制定了《野生药材资源保护管理条例》。国家对野生药材资源实行保护、采猎相结合的原则，加强中药材野生资源的采集和抚育管理，并创造条件开展人工种养。在我国境内采集使用国家保护品种的任何单位或个人，都要严格按规定履行审批手续国家保护野生中药材资源，严禁非法贩卖野生动物和非法采挖野生中药材资源。